临床上可以分为急性假膜性、慢性增生性、慢性萎缩性、肉芽肿性等四种类型的疾病为哪项
A. 念珠菌病
B. 结节病
C. 疱疹性口炎
D. 多形性红斑
E. 白塞综合征

正确答案：A。念珠菌病

解析：念珠菌病临床可分为：急性假膜性念珠菌病（雪口）；慢性增生性念珠菌病（白斑型念珠菌病）；慢性萎缩性念珠菌病（又称托牙性口炎）；肉芽肿性念珠菌病。掌握“口腔念珠菌病与肉芽肿性唇炎”知识点。